男性，37岁，急刹车致使方向盘挤压上腹部16小时，上腹部腰部及右肩疼痛，持续性，伴恶心呕吐。查体：体温38.4℃，上腹部肌紧张明显，有压痛，反跳痛不明显，无移动性浊音，肠鸣音存在，怀疑胰腺损伤。对明确诊断帮助不大的是
A. B超
B. CT
C. 红细胞压积
D. 尿淀粉酶
E. 血淀粉酶

正确答案：C。红细胞压积

解析：胰腺损伤较轻时可仅有胰腺水肿，重者胰腺破裂、出血及胰液外渗可引起胰腺周围积液、积血。红细胞压积（C错，为本题正确答案）又称血细胞比容（HCT），指血细胞在血液中所占容积的比值，HCT可用于判断腹腔内出血的严重程度，对确诊胰腺损伤价值不大。B超（A对）可以发现回声不均匀的胰腺及其周围积血、积液情况；CT（B对）可以显示胰腺轮廓是否整齐及其周围有无积血、积液；血（E对）、尿淀粉酶（D对）在胰腺炎、胰腺损伤的患者中常常升高，上述检查均对明确该患者胰腺损伤的诊断具有一定的参考价值。